《难经》认为命门为
A. 右肾为命门
B. 命门为两肾的总称
C. 两肾之间为命门
D. 命门为肾间动气
E. 命门为精室

正确答案：A。右肾为命门

解析：自《难经》提出“右肾为命门”（A对）之后，历代医家对命门的部位、形态及生理功能各有发挥。明代虞传明确提出“两肾总号为命门”一说，即命门为两肾的总称（B错）；明代赵献可认为两肾之间为命门（C错），“且无形可见”；明代孙一奎认为命门乃“肾间动气”（D错），为元气发动之机，生生不息造化之机枢；明代张介宾提出“命门为产门、精关”，他在《类经附翼·真阴论》中提到“肾有精室，是曰命门”（E错）。